有关干燥的叙述，错误的是
A. 干燥过程是水分连续进行内部扩散和表面气化的过程
B. 干燥速率取决于内部扩散和表面气化速率
C. 干燥过程可明显地分为恒速、降速和加速三个阶段
D. 干燥介质的温度、湿度及流动情况等均可影响恒速阶段的干燥
E. 干燥可去除被干燥物料中的自由水分而不能去除平衡水分

正确答案：C。干燥过程可明显地分为恒速、降速和加速三个阶段